下述液体药剂附加剂的作用为：丙二醇
A. 极性溶剂
B. 非极性溶剂
C. 防腐剂
D. 矫味剂
E. 半极性溶剂

正确答案：E。半极性溶剂

解析：本题考查液体制剂的溶剂。丙二醇作为液体药剂附加剂的作用为半极性溶剂（E对AB错）；防腐剂（C错）是能抑制微生物活动,防止食品腐败变质的一类食品添加剂；矫味剂（D错）指药品中用以改善或屏蔽药物不良气味和味道的药用辅料，有单糖浆、蔗糖等。